敌百虫中毒者洗胃禁用
A. 1：5000高锰酸钾
B. 2%碳酸氢钠
C. 0.3%过氧化氢
D. 0.3%氧化镁
E. 5%碳酸钠

正确答案：B。2%碳酸氢钠

解析：有机磷中毒时，洗胃一般可选用清水、2%碳酸氢钠溶液或1：5000高锰酸钾溶液，但敌百虫中毒时不宜使用2%碳酸氢钠溶液（B对），因其遇碱可变成毒性更强的敌敌畏。对硫磷中毒时不宜使用1：5000高锰酸钾溶液，因其可被氧化成毒性更强的对氧磷。